应当定期对医师和药师进行抗菌药物临床应用知识和规范化管理的培训的是
A. 一级乙等医院
B. 一级甲等医院
C. 二级以上医院
D. 三级甲等医院
E. 三级医院

正确答案：C。二级以上医院

解析：二级以上医院应当定期对医师和药师进行抗菌药物临床应用知识和规范化管理的培训。掌握“抗菌药物临床应用、监督及法律责任”知识点。